某物质在试验时间内对受试动物不显示任何毒性损害的剂量水平称为
A. MNL
B. LOAEL
C. LD50
D. MRL
E. ADI

正确答案：A。MNL

解析：本题考查MNL。某物质在试验时间内对受试动物不显示任何毒性损害的剂量水平称为动物最大无作用剂量（MNL）（A对BCDE错）。